CO₂在血液中运输的主要形式是
A. 和水结合形成碳酸
B. 形成碳酸氢盐
C. 形成一氧化碳血红蛋白
D. 形成氨基甲酸血红蛋白
E. 物理溶解

正确答案：B。形成碳酸氢盐